阿托品可用于
A. 减少全麻时的腺体分泌
B. 全麻时的骨骼肌松弛
C. 有机磷中毒抢救
D. 感染性休克伴高热
E. 虹膜睫状体炎

正确答案：A、C、E。减少全麻时的腺体分泌；有机磷中毒抢救；虹膜睫状体炎

解析：本题考查阿托品。阿托品临床用于解除平滑肌痉挛、解除有机磷中毒（C对）、抑制腺体分泌（A对）。不用于全麻时骨骼肌松弛（B错）。阿托品还用于感染中毒性休克，但休克伴有心动过速或高热者不宜应用（D错），眼科用于虹膜睫状体炎（E对）。